脊髓
A. 位于椎间孔内
B. 上端与延髓相连
C. 成人下端约平第2腰椎下缘
D. 可分为24个脊髓节段
E. 脊髓节段的划分表面分界清楚

正确答案：B。上端与延髓相连

解析：脊髓位于椎管内（A错），脊髓上端在枕骨大孔处与延髓相连（B对），下端变细呈圆锥状称脊髓圆锥尖端约平对第1腰椎下缘（C错）（新生儿可达第3腰椎下缘），可分为31个节段（D错），在外形上没有明显的节段标志（E错）。